作用于α受体的药物是
A. 肾上腺素
B. 去甲肾上腺素
C. 两者均可
D. 两者均不可

正确答案：C。两者均可

解析：本题考查作用于α受体的药物。去甲肾上腺素为非选择性α受体激动药，激动血管α₁受体使血管平滑肌收缩，除冠状动脉几乎所有小动脉和小静脉均出现强烈收缩作用。肾上腺素为α、β受体激动药。肾上腺素与α受体结合产生缩血管作用，与β₂受体结合则产生扩血管作用（C对）。